严重贫血患者引起组织缺氧，下述指标哪项是对的：
A. 氧分压减小
B. 氧容量变化不大
C. 氧含量可代偿增高
D. 动静脉氧差增大
E. 以上都不对

正确答案：E。以上都不对

解析：由于血红蛋白含量减少，或血红蛋白性质改变，使血液携氧能力降低或与血红蛋白结合的氧不易释出引起的缺氧，称为血液性缺氧。动脉血氧分压正常（A错）、动脉血氧含量降低（C错）、动脉血氧容量降低（B错）、动脉血氧饱和度正常或降低、动-静脉血氧含量差降低（D错,故E为本题正确答案）是严重贫血时引起的血液性缺氧的血氧变化特点。